空气环境灭菌宜采用
A. 环氧乙烷灭菌法
B. 过氧醋酸熏蒸法
C. 干热灭菌法
D. 热压灭菌法
E. 流通蒸汽灭菌法

正确答案：B。过氧醋酸熏蒸法